交通性气胸应采取的首要措施是
A. 胸腔闭式引流
B. 无菌纱布覆盖伤口
C. 胸廓固定术
D. 固定、吸氧
E. 及时抽出胸腔气体

正确答案：B。无菌纱布覆盖伤口

解析：交通性气胸，也称开放性气胸，其急救处理要点为：立即将开放性气胸变为闭合性气胸，并迅速转送至医院。立即使用无菌敷料覆盖伤口是患者送达医院之前的首要措施（B对）；固定、吸氧、胸腔闭式引流是患者送达医院的处理方式（AD错）。胸廓固定术为闭合性单处肋骨骨折的治疗方式（C错）。及时抽出胸腔气体为入院前或院内急救张力性气胸的治疗方式（E错）。